等标污染负荷Pi=mi/ci，ci为
A. 污染物的环境质量标准
B. 污染物的环境卫生标准
C. 污染物的浓度排放标准
D. 污染物的慢性毒作用阈剂量（或阈浓度）
E. 以上都不是

正确答案：C。污染物的浓度排放标准